23岁男性农民，11月份因发热、头痛、呕吐三天为主诉入院。体检：面颈部潮红，双腋下少许出血点，化验：尿常规蛋白（+）红细胞3～10个/HP，末梢血象：WBC23.0×10⁹/L，异型淋巴10%，PLT48×10⁹/L。该患者的诊断可能为
A. 流行性脑脊髓膜炎
B. 斑疹伤寒
C. 流行性出血热
D. 钩端螺旋体病
E. 败血症

正确答案：C。流行性出血热

解析：23岁男性患者，职业农民（男性青壮年农民高发），11月份（流行性出血热高发季节）因发热、头痛、呕吐3天入院（流行性出血热发热期症状），出现发热头痛呕吐症状（流行性出血热发热期表现），面颈部潮红，双腋下少许出血点（出现毛细血管损害征），尿常规蛋白（+），红细胞3～10个/HP（肾功能损害征象），WBC23.0×10⁹/L（成人正常参考值4～10×10⁹/L），异型淋巴10％（淋巴细胞增多，并出现较多的异性淋巴细胞），PLT48×10⁹/L（成人正常参考值100～300×10⁹/L），根据患者的临床表现和实验室检查，该患者的诊断可能为流行性出血热（C对）。流行性脑脊髓膜炎（A错）可见高热寒战皮肤瘀斑，不会出现异型淋巴细胞。斑疹伤寒（B错）有发热、皮疹、中枢神经系统症状，白细胞多在正常范围内。钩体病（D错）常表现为发热、酸痛、全身软、眼红、腿痛、淋巴结肿大，有明显的腓肠肌疼痛，外周血白细胞总数和中性粒细胞轻度增高或正常。败血症（E错）临床表现无特异性，可反复出现的畏寒甚至寒战，高热可呈弛张型或间歇型，以瘀点为主的皮疹，累及大关节的关节痛，轻度的肝脾大，重者可有神志改变、心肌炎、感染性休克、DIC、呼吸窘迫综合征等，外周血白细胞升高，各种不同致病菌所引起的败血症，临床特点各不相同。流行性出血热发热期临床表现总结口诀如下：“发热三红醉酒貌，头腰眼痛像感冒，腋下鞭击出血点，恶心呕吐蛋白尿”。